人类自然环境由下列圈带构成，哪项除外
A. 生物圈
B. 大气圈
C. 水圈
D. 非生物圈
E. 土壤岩石圈

正确答案：D。非生物圈

解析：本题考查自然环境的构成。在地球形成演化的过程中，构成了大气圈、水圈和土壤岩石圈三个基本圈带。随后，大气和海洋，以及大气和固体陆地表面之间的交接上产生了生物，生物的长期繁衍形成了生物圈。大气圈（B对）、水圈（C对）、土壤岩石圈（E对）和生物圈（A对）共同组成了人类的自然环境。非生物圈（D错，为本题正确答案）不是自然环境的构成。